吗啡不具有下列哪项作用
A. 兴奋平滑肌
B. 止咳
C. 腹泻
D. 呼吸抑制
E. 催吐和缩瞳

正确答案：C。腹泻

解析：本题考查吗啡。吗啡为阿片受体激动药，通过激动μ₂受体，松弛胃肠道平滑肌，减少其蠕动（A对），从而达到止泻作用（C错，为本题正确答案）；吗啡能够镇咳（B对）；吗啡的其它不良反应包括呼吸抑制（D对）、支气管痉挛，少见瞳孔缩小等（E对）。